在职业病的危害防治和职业人群健康监护中，不属于第一级预防的措施是
A. 加强通风排毒
B. 改革工艺，采用无毒原料
C. 生产过程机械化、自动化、密闭化
D. 制订职业接触限值
E. 定期对工人进行体检

正确答案：E。定期对工人进行体检

解析：职业病的第一级预防要求从根本上阻止职业性有害因素对人体的损害作用。加强通风排毒可以防止生产过程中毒物逸散到空气中（A对）。改革工艺，采用无毒原料可以从生产工艺流程中消除有毒物质（B对）。生产过程机械化、自动化、密闭化也可以消除毒物的逸散，并且最大限度地减少操作者接触毒物的机会（C对）。制订职业接触限值，设立最高容许浓度可以保证绝大多数劳动者在生产过程中不对有害因素产生反应（D对）。在岗期间健康检查是指用人单位按一定时间间隔对从事某种作业工人的健康状况进行检查，属于二级预防（E错，为本题正确答案）。